药物在一定比例混合溶剂中溶解度大于在单一溶剂中溶解度的现象是
A. 絮凝
B. 增溶
C. 助溶
D. 潜溶
E. 盐析

正确答案：D。潜溶

解析：本题考查液体制剂常用的附加剂。潜溶（D对）是指当混合溶剂中各溶剂达某一比例时,药物的溶解度比在各单纯溶剂中溶解度大的现象；絮凝（A错）是指使水或液体中悬浮微粒集聚变大，或形成絮团，从而加快粒子的聚沉，达到固-液分离的目的；增溶（B错）是指难溶性药物在表面活性剂的作用下，在溶剂中增加溶解度并形成溶液的过程；助溶（C错）是指难溶性药物与加入的第三种物质在溶剂中形成可溶性分子间的络合物、缔合物或复盐等，以增加药物在溶剂中的溶解度；盐析（E错）一般是指盐溶液中加入无机盐类而使某种物质溶解度降低而析出的过程。